儿童期功能低下时可导致呆小症
A. 垂体
B. 胰岛
C. 甲状腺
D. 甲状旁腺
E. 肾上腺

正确答案：C。甲状腺

解析：甲状腺（C对）分泌甲状腺素，可提高神经兴奋性，促进生长发育。儿童期甲状腺功能低下时，可导致呆小症。